临床记录中，颊面以英文字母命名
A. L
B. B
C. O
D. La
E. I

正确答案：B。B

解析：窝洞的命名以英文字母命名：颊面buccal写为B：舌面lingual写为L；（牙合）面occlusal写为O；远中面distal写为D；近中面mesial写为M；唇面labial写为La；切端incisal写为I。掌握“龋病治疗出现问题及处理”知识点。